用于治疗水肿性疾病，当起始治疗剂量未达到满意的治疗效果时，可追加剂量，每日最大剂量可达600mg。但一般应控制在100mg以内的利尿剂是
A. 布美他尼
B. 依他尼酸
C. 呋塞米
D. 托拉塞米
E. 吲达帕胺

正确答案：C。呋塞米

解析：本题考查呋塞米。用于治疗水肿性疾病，当起始治疗剂量未达到满意的治疗效果时，可追加剂量，每日最大剂量可达600mg。但一般应控制在100mg以内的利尿剂是呋塞米（C对）。呋塞米用于水肿性疾病，起始20～40mg, 一日1次，必要时6～8h后追加20～40mg, 直至出现满意利尿效果。最大剂量虽可达一日600mg, 但一般应控制在100mg内，分2～3次服，以防过度利尿和不良反应的发生。布美他尼（A错）口服用于水肿性疾病，成人，初始剂量一次 0.5～2mg, 一日1次，必要时每隔4～5h重复，最大剂量一日10～20mg也可间隔用药，即隔1～2日用药1日。依他尼酸（B错）成人治疗水肿性疾病，起始剂量为50mg，上午一次顿服，进餐或餐后立即服用。按需要每日增加剂量25～50mg，直至最小有效剂量。一般有效剂量范围为每日50～150mg，最大剂量每日400mg。剂量大于每日500mg时应分次服用。维持剂量多为每日50～200mg，每日或隔1～2日服用1次。托拉塞米（D错）用于肾脏疾病所致的水肿，初始剂量一次20mg, 一日1次，以后根据需要可逐渐增加
剂量至最大剂量一日100mg, 疗程不超过1周。吲达帕胺在临床上主要用于Ⅰ、Ⅱ期高血压以及多种原因所致的轻、中度水肿。口服成人常用量，一次2.5mg，一日1次。